患者，女，61岁，体检发现重度骨质疏松，既往患有食管裂孔疝、高血压、2型糖尿病。长期服用奥美拉唑肠溶片、厄贝沙坦-氢氯噻嗪片，氨氯地平片、阿卡波糖片、阿司匹林肠溶片。实验室检查结果：肝、肾功能正常。骨质疏松的药物治疗方案中，不适合该患者的是
A. 碳酸钙片0.5g tid
B. 骨化三醇胶丸0.25㎍ bid
C. 阿仑膦酸钠片70mg qw
D. 鲑降钙素鼻喷剂100IU qd
E. 特立帕肽注射液20㎍ qd

正确答案：C。阿仑膦酸钠片70mg qw

解析：本题考查骨质疏松的药物治疗方案。食管炎为双磷酸盐类（如阿仑膦酸钠片）（C错，为本题正确答案）药物的主要不良反应，粪隐血阳性，有食管裂孔疝、消化性溃疡者不宜应用。